患儿，4岁。有哮喘病史，此次喘促迁延不愈月余，动则喘甚，面白少华，形寒肢冷，小便清长，伴见咳嗽痰多，喉间痰鸣，舌质淡，苔白腻，脉细弱。其证型是
A. 寒性哮喘
B. 热性哮喘
C. 虚实夹杂
D. 肺脾气虚
E. 肾虚不纳

正确答案：C。虚实夹杂

解析：本病例已明确诊断哮喘。喘促迁延不愈月余，动则喘甚，面白少华，形寒肢冷，小便清长，脉细弱，提示为虚证；咳嗽痰多，喉间痰鸣，苔白腻，提示有痰邪，故此为虚实夹杂--久病哮喘，迁延不愈，正虚邪恋，虚实夹杂，上盛（肺实、有痰邪为患）下虚（肾虚）（C对）。寒性哮喘（A错）以咳嗽气促，喉间哮鸣，痰白清稀，呈黏沫状，形寒无汗，面色晦滞带青，四肢不温，口不渴，或渴喜热饮，舌淡红，舌苔薄白或白腻，脉象浮滑，为主要临床特征。热性哮喘（B错）以咳喘哮鸣，声高息涌，痰稠色黄，发热面红，胸闷膈满，渴喜冷饮，小便黄赤，大便干燥或秘结，舌红，舌苔黄腻，脉象滑数，为主要临床特征。肺脾气虚（D错）证多表现为反复感冒，气短自汗，咳嗽无力，神疲懒言，形瘦纳差，面白少华，便溏，舌质淡，苔薄白，脉细软。肾虚不纳（E错）多表现为面色㿠白，畏寒肢冷，腰膝酸软，动则心悸气促，遗尿或夜间尿多，小便澄清，舌淡，苔薄白，或舌红，苔花剥，脉沉细无力，本病例除有下虚肾亏的临床表现外，尚有上盛肺实的临床表现。